女性，28岁。婚后3天突起畏寒高热，尿频伴尿急，侧腰痛，既往无类似发作。尿常规：蛋白阴性，红细胞（0~3）个/HP，白细胞﹢﹢/HP。根据上述病情，首先考虑诊断为
A. 无症状性菌尿
B. 急性膀胱炎
C. 急性肾盂肾炎
D. 慢性肾盂肾炎
E. 尿道综合征

正确答案：C。急性肾盂肾炎